苦参碱的结构特点和性质有
A. 有四种异构体
B. 多为粉末
C. 含有两个N原子
D. 既溶于水，又溶于乙醚
E. 挥发性

正确答案：A、C、D。有四种异构体；含有两个N原子；既溶于水，又溶于乙醚

解析：本题考查的是苦参生物碱的理化性质。苦参碱的结构特点和性质有有四种异构体（A对）、含有两个N原子（C对）与既溶于水，又溶于乙醚（D对）。苦参碱的理化性质：（1）性状：苦参碱有α-、β-、γ-、δ-四种异构体。其中α-、β-、δ-苦参碱为结晶体。γ-苦参碱为液态，沸点223℃/6mmHg（E错）。（2）碱性：苦参中所含生物碱均有两个氮原子，一个为叔胺氮（1位氮），呈碱性；另一个为酰胺氮（16位氮），几乎不显碱性，所以它们只相当于一元碱。但这类生物碱都是喹喏里西啶的衍生物，由两个哌啶环骈合而成，呈叔胺状态的氮原子处于骈合环之间，立体效应影响较小，所以苦参碱和氧化苦参碱的碱性较强。（3）溶解性：苦参碱的溶解性比较特殊，既可溶于水，又能溶于三氯甲烷、乙醚、苯、二硫化碳等亲脂性溶剂。苦参碱具内酰胺结构，可在碱性溶液中加热水解皂化成羧酸衍生物，酸化后又环合析出。